在紫外-可见分光光度法中，与溶液浓度和液层厚度成正比的是
A. 透光率
B. 测定波长
C. 狭缝宽度
D. 吸光度
E. 吸收系数

正确答案：D。吸光度

解析：本题考查紫外-可见分光光度法。在紫外-可见分光光度法中，与溶液浓度和液层厚度成正比的是吸光度（D对）。朗伯比尔定律的物理意义：当一束平行单色光通过单一均匀的、非散射的吸光物质溶液时，溶液的吸光度与溶液浓度和液层厚度的乘积成正比。其关系式为：A=-lgI/I₀=-lgT=ECl，其中测定波长（B错）和狭缝宽度（C错）是一定的，与溶液的浓度和液层厚度无关。吸收系数E（E错）是物理常数。透光率（A错）T则与药物溶液浓度和液层厚度成反比。